五脏中有主水和纳气功能的是
A. 肝
B. 心
C. 脾
D. 肺
E. 肾

正确答案：E。肾

解析：肾主水是指肾脏有主持和调节人体律液代谢的生理功能；肾主纳气，是指肾具有摄纳肺吸入之清气，防止呼吸表浅，以保证体内外气体正常交换的功能（E对）。肝主疏泄，主藏血（A错）。心主血脉，主藏神（B错）。脾主运化与主统血（C错）。肺主气司呼吸，主行水，朝百脉，主治节（D错）。